其外毒素作用于神经系统，引起痉挛性麻痹的细菌是
A. 产气荚膜梭菌
B. 破伤风梭菌
C. 无芽胞厌氧菌
D. 肉毒杆菌
E. 艰难梭菌

正确答案：B。破伤风梭菌

解析：本题考查外毒素作用于神经系统引起痉挛性麻痹的细菌。其外毒素作用于神经系统，引起痉挛性麻痹的细菌是破伤风梭菌（B对）。当破伤风痉挛毒素阻止抑制性神经介质的释放，干扰了抑制性神经元的协调作用，迫使肌肉活动的兴奋与抑制失调，导致屈肌、伸肌同时发生强烈收缩，骨骼肌出现强烈痉挛。产气荚膜梭菌（A错）能产生多种外毒素，其中α毒素毒性最强最重要，可造成细胞溶解，所致疾病包括气性坏疽、食物中毒等。无芽胞厌氧菌（C错）是寄生于人体体表及与外界相通腔道中的正常菌群，可作为机会致病菌导致内源性感染，包括败血症、中枢神经系统感染、口腔感染、呼吸道感染、腹部和会阴部感染、女性生殖道和盆腔感染等。肉毒杆菌（D错）主要存在于土壤中，在厌氧环境下能产生毒性极强的肉毒毒素，其作用于外周胆碱能神经，抑制神经肌肉接点处神经介质乙酰胆碱的释放，导致迟缓性麻痹，所致疾病包括食物中毒、婴儿肉毒病及创伤感染中毒。艰难梭菌（E错）是人类肠道中正常菌群之一，当患者长期使用或不规范使用某些抗生素以后，可引起肠道内的菌群失调，耐药的艰难梭菌可产生肠毒素和细胞毒素，可导致抗生素相关性腹泻和家模型结肠炎等疾病。